明代对药学发展贡献最大的本草著作是
A. 《神农本草经》
B. 《新修本草》
C. 《图经本草》
D. 《经史证类备急本草》
E. 《本草纲目》

正确答案：E。《本草纲目》

解析：本题考查的是历代本草代表作。明代对药学发展贡献最大的本草著作是《本草纲目》（E对）。《本草纲目》：简称《纲目》，为明代本草代表作。作者李时珍。该书不仅集我国16世纪以前药学成就之大成，将本草学的发展提高到一个空前的高度，而且在生物、化学、天文、地理、地质、采矿等方面也有突出的成就，对世界医药学和自然科学的许多领域做出了举世公认的卓越贡献。《神农本草经》（A错）：简称《本经》，为汉代本草代表作。该书系统总结了汉代以前我国药学发展的成就，是现存最早的药学专著，为本草学的发展奠定了基础。《新修本草》（B错）：又称《唐本草》，为隋唐时期唐代的本草代表作。本书是我国历史上第一部官修药典性本草，并被今人誉为世界上第一部药典。该书无论在内容和编写形式上都有新的突破，全面总结了唐以前的药物学成就，并很快流传下海内外，对后世医药学的发展影响极大。《经史证类备急本草》（D错）：简称《证类本草》，为宋金元时期宋代的本草代表作。作者唐慎微，以掌禹锡的《嘉祐本草》和苏颂的《图经本草》（C错）为基础，并收集转录了大量宋以前各代名医对本草的真知灼见、经史传记和佛书道藏中有关本草的论述，以及民间防治疾病的经验和单方，撰成此书。该书图文对照，方药并收，医药结合，资料翔实，集宋以前本草之大成，使大量古代文献得以保存，具有极高的学术价值和文献价值。